不属于1岁以内婴儿计划免疫的是
A. 脊髓灰质炎疫苗
B. 肺炎链球菌疫苗
C. 麻疹疫苗
D. 百日咳疫苗
E. 乙肝疫苗

正确答案：B。肺炎链球菌疫苗

解析：肺炎链球菌疫苗（B错，为本题正确答案）属于选择性接种的免疫疫苗。1岁内的婴儿计划免疫包括卡介苗，脊髓灰质炎疫苗（A对），麻疹疫苗（C对），百日咳疫苗（D对）、白喉、破伤风类毒素混合制剂， 乙肝疫苗（E对）。